采取非手术方法治疗急性消化性溃疡穿孔，错误的处理措施是
A. 静脉应用质子泵抑制剂
B. 胃肠减压
C. 静脉应用抗生素
D. 静脉输液，营养支持
E. 静脉应用糖皮质激素

正确答案：E。静脉应用糖皮质激素

解析：质子泵抑制剂抑酸作用很强，可使胃内达到无酸水平，多在2～3天内控制消化性溃疡症状（A对）。大量抗生素（C对）、镇静镇痛治疗、胃肠减压（B对）、补液、营养（D对）为一般非手术治疗措施，适用于病情轻或病情超过24h，且腹部体征已减轻或伴有严重心肺等脏器疾患不能耐受手术。胃排空障碍常发生于术后最初2周，多数病人经胃肠减压、输液、输血、应用糖皮质激素（E错，为本题正确答案）、胃肠外营养等保守治疗后症状缓解。